巨幼红细胞贫血患者，如用维生素B₁₂治疗常表现疗效良好，其原因可能是维生素B₁₂促进下述哪种FH₄的重新利用
A. N₅N₁₀-CH-FH₄
B. N₅N₁₀-CH-FH₄
C. N₅-CH₃-FH₄中的FH₄
D. N₁₀-CHO-FH₄中的FH₄
E. N₅-CHNH-FH₄中的FH₄

正确答案：C。N₅-CH₃-FH₄中的FH₄